肿瘤化疗的病人最好选用
A. 悬浮红细胞
B. 洗涤红细胞
C. 辐照红细胞
D. 浓缩红细胞
E. 去白红细胞

正确答案：A。悬浮红细胞

解析：悬浮红细胞适用于大多数需要补充红细胞，提高血液携氧能力的患者，肿瘤化疗的病人最好选用悬浮红细胞（A对）。洗涤红细胞（B错）适应症为对白细胞凝集素有发热反应者及肾功能不全不能耐受库存血中之高钾者。辐照红细胞（C错）是用射线照射灭活活性淋巴细胞的红细胞制剂，用来预防输血相关性移植物抗宿主病的发生。浓缩红细胞（D错）适应症一般为各种急性失血，慢性贫血及心功能不全者。去白红细胞（E错）适应症为①多次输血后产生白细胞抗体者；②预期需要长期或反复输血者。